下列相互作用属于拮抗作用的是
A. 生化性拮抗
B. 生理性拮抗
C. 药理性拮抗
D. 化学性拮抗
E. 物理性拮抗

正确答案：A、B、C、D。生化性拮抗；生理性拮抗；药理性拮抗；化学性拮抗

解析：本题考查拮抗作用。药物效应的拮抗作用指两种或两种以上药物联合用药时的效果小于单用效果之和，或一种药物部分或全部抵抗另一种药物的作用，包括生理性拮抗（B对）、生化性拮抗（A对）、化学性拮抗（D对）和药理性拮抗（C对）。